关于免疫细胞和膜分子，错误的组合是
A. 辅助性T细胞CD4抗原阳性
B. 单核吞噬细胞MHC-Ⅱ类抗原阳性
C. 细胞毒性T细胞CD8抗原阳性
D. NK细胞-CD4抗原阳性
E. 人红细胞MHC-I类抗原阴性

正确答案：D。NK细胞-CD4抗原阳性

解析：根据T细胞的功能，将T细胞分为辅助性T细胞、细胞毒性T细胞、调节性T细胞等，辅助性T细胞的CD4抗原阳性（A对），细胞毒性T细胞的CD8抗原阳性（C对）。MHC-I类分子表达于所有有核细胞，人成熟的红细胞没有细胞核，人红细胞的MHC-I类抗原阴性（E对）。MHC-Ⅱ类分子仅表达于淋巴组织中一些特定细胞表面，如专职性抗原提呈细胞（巨噬细胞、树突状细胞等），因此单核吞噬细胞的MHC-Ⅱ类抗原阳性（B对）。CD4抗原表达于60%～65%T细胞及部分NKT细胞（D错，为本题正确答案），巨噬细胞和树突状细胞亦可表达CD4，但水平较低。